具体地讲，环境介质是指
A. 空气、水、土壤（岩石）
B. 空气、水、土壤（岩石）和生物体
C. 空气、水、土壤（岩石）和食物
D. 空气、水、食物、生物体
E. 空气、水以及各种固态物质

正确答案：B。空气、水、土壤（岩石）和生物体

解析：本题考查环境介质。环境介质是指空气、水、土壤（岩石）以及包括人体在内的所有生物体（B对ACDE错）。